治疗湿热淋痛，疥癣瘙痒的药物是
A. 黄柏
B. 苦参
C. 秦皮
D. 龙胆
E. 天花粉

正确答案：B。苦参

解析：本题考查的是苦参的主治病证。治疗湿热淋痛，疥癣瘙痒的药物是苦参（B对）。苦参：【主治病证】（1）湿疮，湿疹，疥癣，麻风，阴痒，带下。（2）湿热黄疸、泻痢、便血。（3）湿热淋痛，小便不利。黄柏（A错）：【主治病证】（1）湿热下注之带下、淋浊、脚气、足膝红肿。（2）湿热黄疸，湿热泻痢，湿疹，湿疮。（3）热毒疮肿，口舌生疮，血热出血。（4）阴虚之盗汗遗精，骨蒸潮热。秦皮（C错）：【主治病证】（1）湿热泻痢。（2）赤白带下。（3）目赤肿痛，目生翳膜。龙胆（D错）：【主治病证】（1）湿热下注之阴肿阴痒、带下、阴囊湿疹，湿热黄疸。（2）肝火上炎之头痛目赤、耳聋胁痛等。（3）高热抽搐，小儿急惊，带状疱疹。天花粉（E错）：【主治病证】（1）热病伤津口渴，内热消渴。（2）肺热咳嗽，燥咳痰黏，咳痰带血。（3）痈肿疮疡，跌打肿痛。此外，制成天花粉蛋白注射液肌内注射又能引产。